症见肠鸣沥沥有声，其病机为
A. 饮在胸胁
B. 饮在胸膈
C. 饮在肠间
D. 饮溢肌肤
E. 饮伏体内

正确答案：C。饮在肠间

解析：本题考查饮的病症特点，属于理解记忆内容。饮的病症特点是：饮在肠间，则肠鸣沥沥有声（C对）；饮在胸胁，则胸胁胀满，咳唾引痛（A错）；饮在胸膈，则胸闷、咳喘，不能平卧，其形如肿（B错）；饮溢肌肤，则见肌肤水肿、无汗，身体疼痛（D错）。